确定对某传染病接触者留验、检疫或医学观察的主要依据是该传染病的
A. 传染期
B. 潜伏期
C. 临床症状期
D. 恢复期
E. 病原携带期

正确答案：B。潜伏期